男，50岁。散步时突然倒地。查体：意识丧失，大动脉搏动消失，抽泣样呼吸，随即消失。应首先采取的措施是
A. 舌下含服硝酸甘油
B. 开放气道
C. 人工呼吸
D. 按压人中
E. 胸外按压

正确答案：E。胸外按压

解析：患者男，50岁。散步时突然倒地。查体：意识丧失，大动脉搏动消失，发生了心脏骤停。心脏骤停是指心脏射血功能突然终止，10秒左右患者即可出现意识丧失，心脏骤停刚发生时脑中尚存少量含氧的血液，可暂时刺激呼吸中枢，出现呼吸断续，抽泣样，随后呼吸停止。心脏骤停抢救成功的关键是尽早进行心肺复苏（胸外按压）（E对）。舌下含服硝酸甘油（A错）是心绞痛发作时的治疗方法。开放气道（B错）和人工呼吸（C错）是心脏骤停的处理措施，但不是首要措施。